冠部浅龋的龋坏程度仅限于
A. 牙釉质内
B. 釉牙本质内
C. 釉质或根面牙骨质层内
D. 牙本质内
E. 牙骨质或牙本质内

正确答案：A。牙釉质内

解析：本题考查龋病的临床表现与分类。浅龋的龋损在釉质或根面牙骨质层内。题目要求选择冠部（釉质覆盖部分）浅龋，所以冠部浅龋局限于牙釉质（A对）。